全口义齿与唇颊肌作用关系最密切的表面是
A. 牙平面
B. 磨光面
C. 咬合面
D. 组织面
E. 吸附面

正确答案：B。磨光面

解析：本题考查全口义齿的三个表面。义齿主要包括咬合面、磨光面和组织面。磨光面（B对）是指义齿与唇、颊和舌肌接触的部分，磨光面要求做成凹面，有利于义齿的稳定。咬合面（C错）是上下颌牙咬合接触的面。组织面（D错）是义齿基托与口腔黏膜组织接触的面。全口义齿表面没有牙平面（A错）、吸附面（E错）。